大多数脱氢酶的辅酶是
A. FADH₂
B. NAD⁺
C. Cyt-c
D. CoA
E. NADP⁺

正确答案：B。NAD⁺

解析：NAD⁺，NADP⁺，FMN或者FAD都是脱氢酶的辅酶。NAD⁺（B对）是生物氧化中的最重要的递氢体和电子传递体，是大多数脱氢酶的辅酶；NADP⁺（E错）则多参与许多代谢反应，是少数脱氢酶的辅酶。FAD是脱氢酶的辅酶，FADH₂（A错）是其还原态产物。Cyt（C错）是一类含血红素样辅基的电子传递蛋白，生物氧化中的电子传递体。CoA（D错）是转酰基酶的辅酶（D错）。